关于流脑，不正确的是
A. 脑膜炎球菌在流行期间正常人携带率较高，但发病率较低
B. 注射脑膜炎球菌多糖疫苗可预防流脑
C. 普遍易感，儿童发病最多
D. 全年均可发生，但自冬末至来年3～4月份为高峰
E. 流脑可通过食物传播

正确答案：E。流脑可通过食物传播